慢性肾功能不全尿毒症期血肌酐应是
A. Cr＞707μmol／L
B. Cr＞178μmol／L
C. Cr＞884μmol／L
D. Cr＞278μmol／L
E. Cr＞450μmol／L

正确答案：A。Cr＞707μmol／L